灌注于骨节、脏腑、脑、髓等组织的物质是
A. 津
B. 液
C. 卫气
D. 宗气
E. 营气

正确答案：B。液

解析：本题考查的是津液的分布。灌注于骨节、脏腑、脑、髓等组织的物质是液（B对）。津（A错）和液，同属于水液，来源于饮食，有赖于脾胃运化功能，以及小肠主液、大肠主津的功能活动而生成。由于津和液的性状、功能及分布部位有所不同，因而又有一定的区别。一般来说，质地较清稀，流动性较大，布散于体表皮肤、肌肉和孔窍，并能渗注于血脉，起滋润作用的，称为津；质地较稠厚，流动性较小，灌注于骨节、脏腑、脑、髓等组织，起濡养作用的，则称为液。津和液之间可以相互转化，故津和液常同时并称。但在对“伤津”和“脱液”等进行辨证论治时，又须加以区别。卫气（C错）：与营气相对而言，卫气行于脉外而属阳，又称“卫阳”。卫气主要由水谷精气所化生，运行于脉外。卫气活动力特别强，流动迅速，故不受脉管的约束，可运行于皮肤、分肉之间，布散于全身内外上下。宗气（D错）：是积于胸中之气。宗气在胸中集聚之处，称作“气海”，又称“膻中”。宗气聚集于胸中，向上分布于肺与息道，向下贯注于心脉，布散全身。营气（E错）：又称“荣气”，与卫气相对而言，营气行于脉内而属阴，故又有“营阴”之称。营气运行于全身血脉之中，成为血液的重要组成部分。